关于伦理决策错误的是
A. 即作伦理上的决定
B. 是一个复杂的过程
C. 受个人价值观的影响
D. 受社会文化、法律法规的影响
E. 不受宗教信仰和个人情绪状况的影响

正确答案：E。不受宗教信仰和个人情绪状况的影响

解析：伦理决策即“作伦理上的决定”。在伦理上作决定是一个复杂的过程，既受到个人价值观的影响，也受到社会文化、宗教信仰、法律法规、社会环境及当时的个人情绪状况等因素的影响。所以，决策参与者的道德水平、知识程度以及对伦理理论、原则应用的水平和能力都会影响决策者在某一情景中所采取的道德行动的正确性。掌握“临床治疗的伦理决策”知识点。